女，30岁。妊娠33周，反复阴道流血3次，量少于月经量，无腹痛不适，臀位。胎心正常，G8P3，曾人工流产4次。该孕妇在临产后容易发生的情况是
A. 死产
B. 子宫破裂
C. 胎儿窘迫
D. 羊水栓塞
E. 出血

正确答案：E。出血

解析：妊娠晚期妇女，既往有多次流产史、多孕产次（前置胎盘高危因素），反复阴道流血，无腹痛不适，胎位清楚。据患者生育史、临床表现及查体，最可能的诊断是前置胎盘。胎盘前置时对母儿影响严重：1.产后出血 因局部胎盘较难剥离，最常见可造成产后出血（E对）；2.若出血量多，则可致胎儿窘迫（C错），甚至死产（A错）；3.植入性胎盘；4.产褥感染。